男，38岁。腹痛，反酸9年。1周来症状加重，并出现夜间痛，进食能部分缓解。最有助于明确诊断的检查是
A. 胃液分析
B. 胃肠钡餐
C. 胃镜
D. 结肠镜
E. 腹部B超

正确答案：C。胃镜

解析：该患者诊断为十二指肠溃疡，明确诊断首选胃镜（C对），其普及率高，操作便捷且损伤小，对于难以诊断的消化性溃疡还可取活组织病理检查确诊。胃液分析（A错）可测定基础胃酸分泌量（BAO）和最大胃酸分泌量（MAO），了解溃疡病患者胃酸分泌情况，现已少用。胃肠钡餐（B错）效果逊于胃镜，用于胃镜禁忌者、不愿接受胃镜检查者和没有胃镜时。结肠镜（D错）用于检查结直肠病变，而该患者病变在十二指肠，故无需使用结肠镜。腹部B超（E错）受气体阻碍，对空腔脏器检查效果不佳。